因取直立位可使头痛加重的是
A. 丛集性头痛
B. 腰椎穿刺后头痛
C. 颈肌急性炎症
D. 神经官能症
E. 脑肿瘤

正确答案：B。腰椎穿刺后头痛

解析：腰椎穿刺后的头痛在直立位时加重（B对）。丛集性头痛在站位可缓解（A错）。神经性头痛因精神紧张、失眠等诱发（D错）。如咳嗽、转头、俯首等使颅内压增高的动作，常使脑肿瘤、脑膜炎及血管性头痛加剧（E错）。颈部活动受限伴有疼痛，见于颈部肌肉扭伤、劳损，颈部软组织炎症（C错），颈椎炎症、结核、肿瘤等。